经延髓脑桥沟出入的脑神经是
A. 面神经
B. 舌下神经
C. 迷走神经
D. 舌咽神经
E. 三叉神经

正确答案：A。面神经

解析：面神经（A对）连于脑桥延髓沟外侧部，经内耳门、内耳道达内耳道底，穿内耳道底入面神经管，最后从茎乳孔出颅。舌下神经（B错）为运动性神经，含一般躯体运动纤维，起自延髓舌下神经核，在延髓锥体与橄榄体之间出脑，经舌下神经管出颅。迷走神经（C错）连于橄榄后沟，舌咽神经下方，与舌咽神经和副神经一起穿颈静脉孔出颅。舌咽神经（D错）经颈静脉孔出颅腔后，于颈内动、静脉之间下行，然后呈弓形向前绕茎突咽肌外侧，至舌骨舌肌深面达舌根。三叉神经（E错）自脑桥基底部与小脑中脚交界处出脑，位于感觉根下内侧，纤维并入下颌神经，经卵圆孔出颅。